正确描述右心室的是
A. 位于右心房的左前下方
B. 室壁比左心室壁厚
C. 构成心右缘
D. 有冠状窦开口
E. 内面粗糙,有肉柱形成的嵴状隆起

正确答案：A。位于右心房的左前下方

解析：右心室位于右心房的左前下方（A对）。右心室壁较薄（B错）、只有左心室壁厚度的 1/3。右缘（C错）由右心房构成。冠状窦开口（D错）于下腔静脉口与右房室口之间。右心房的后部，内壁光滑，无肌性隆起（E错）。